右冠状动脉
A. 起自主动脉前窦
B. 经右心耳与主动脉根部之间
C. 其分支与心大静脉伴行
D. 自房室交点向左分出左心室后支
E. 分布于室间隔后2/3

正确答案：D。自房室交点向左分出左心室后支

解析：右冠状动脉起于主动脉的冠状动脉右窦（A错）。行于右心耳与肺动脉干（B错）之间。其分支与心中静脉（C错）伴行。自房室交点向左分出左心室后支（D对）。分布于室间隔后1/3（E错）。